《中国药典》（一部）收载的“提取物”包括
A. 以水为溶剂经提取制成的浸膏
B. 乙醇为溶剂经提取制成的干浸膏
C. 以乙醇为溶剂经提取制成的流浸膏
D. 水或乙醇为溶剂经提取制成的含有一类或数类有效成分的有效部位
E. 以水或乙醇为溶剂经提取制成的含量达到90%以上的单一有效成分

正确答案：D、E。水或乙醇为溶剂经提取制成的含有一类或数类有效成分的有效部位；以水或乙醇为溶剂经提取制成的含量达到90%以上的单一有效成分

解析：本题考查《中国药典》（一部）的提取物。《中国药典》（一部）收载的“提取物”包括水或乙醇为溶剂经提取制成的含有一类或数类有效成分的有效部位（D对）、以水或乙醇为溶剂经提取制成的含量达到90%以上的单一有效成分（E对）。